调整患者的抗抑郁药需谨慎。以单胺氧化酶抑制剂替换选择性5-羟色胺再摄入抑制剂时，应该间隔一段时间。至少应间隔
A. 1天
B. 5天
C. 7天
D. 10天
E. 14天

正确答案：E。14天

解析：本题考查抗抑郁药。以单胺氧化酶抑制剂替换选择性5-羟色胺再摄入抑制剂时，应该间隔一段时间。至少应间隔14天（E对）。单胺氧化酶抑制剂在停用2周后才能换用5-HT摄取抑制剂。选择性5-HT再摄取抑制剂与单胺氧化酶抑制剂合用可引起5-HT综合征，表现为不安、肌阵挛、健反射亢进、多汗、震颤、腹泻、高热、抽搐和精神错乱，严重者可致死。